可能存在的高温、强热辐射的作业环境是
A. 缫丝车间
B. 炼钢车间
C. 印染车间
D. 造纸车间
E. 深井煤矿工作场所

正确答案：B。炼钢车间